出现胸骨左缘第2肋间闻及粗糙响亮的连续性机器样杂音，肺动脉瓣第二音亢进，最可能的疾病是
A. 房间隔缺损
B. 室间隔缺损
C. 动脉导管未闭
D. 肺动脉狭窄
E. 法洛四联症

正确答案：C。动脉导管未闭